大出血后出现休克症状，表明至少已丢失全身总血量的
A. 0.1
B. 0.15
C. 0.2
D. 0.25
E. 0.3

正确答案：C。0.2

解析：本题考查失血性休克。大出血后出现休克症状，表明至少已丢失全身总血量的20%（C对ABDE错）。